下列不属于ACEI作用机制的是
A. 使血液及组织中的ATⅡ水平下降
B. 提高血液中的缓激肽水平
C. 使醛固酮的分泌减少
D. 拮抗ATⅡ受体
E. 具有抗交感神经作用

正确答案：D。拮抗ATⅡ受体

解析：拮抗ATⅡ受体（D错，为本题正确答案）属于血管紧张素Ⅱ受体拮抗药的作用机制。ACEI作用机制包括：①使血液即组织中AngⅡ水平下降（A对）和提高血液中的缓激肽水平（B对），来降低外周血管阻力，降低心脏后负荷；②使醛固酮的分泌减少（C对）；③抑制心肌及血管重构；④改善血流动力学情况；⑤降低交感神经活性，具有抗交感神经作用（E对）。